急性化脓性骨髓炎病原菌占首位的是
A. 铜绿假单胞菌
B. 产气荚膜杆菌
C. 白色葡萄球菌
D. 乙型溶血链球菌
E. 金黄色葡萄球菌

正确答案：E。金黄色葡萄球菌

解析：急性化脓性骨髓炎一般为血源性感染，病原菌以金黄色葡萄球菌为最多（占80%～90%），一型溶血性链球菌占第二位。掌握“骨与关节化脓性感染”知识点。